关于骨折愈合的过程，正确的是
A. 原始骨痂形成期膜内成骨比软骨内成骨慢
B. Wolff定律即骨折愈合过程中板层骨总是沿断端承受的生理应力方向吸收
C. 临床上骨折愈合过程多为一期愈合
D. 新骨的爬行替代过程是在破骨细胞和成骨细胞同时作用下完成的
E. 骨板形成塑形期在应力轴线上的骨痂逐渐消失

正确答案：D。新骨的爬行替代过程是在破骨细胞和成骨细胞同时作用下完成的

解析：骨折的愈合过程分为三个阶段：血肿炎症机化期、原始骨痂形成期和骨痂形成塑形期。在骨痂形成塑形期，在新生血管、破骨细胞和成骨细胞的共同作用下，骨折端的死骨被清除，新骨逐渐爬行替代，即新骨的爬行替代过程是在破骨细胞和成骨细胞同时作用下完成的（D对）。根据Wolff定律，成熟骨板经过成骨细胞和破骨细胞相互作用，在应力轴线上成骨细胞相对活跃，有更多的新骨使之形成坚强的板层骨，而在应力轴线以外，破骨细胞相对活跃，是多余的骨痂逐渐被吸收而清除。故骨折愈合过程中板层骨总是沿断端承受的生理应力方向（应力轴线）形成（B错），在应力轴线上的骨痂是逐渐得到了加强和改造（E错）。原始骨痂形成期主要通过膜内成骨和软骨内成骨形成骨痂，膜内成骨要比软骨内成骨快（A错）。骨折的愈合分为一期愈合和二期愈合两种形式，临床上骨折的愈合过程多为二期愈合（C错）。